区别癌与肉瘤的主要依据是
A. 浸润性生长、无包膜
B. 异型性明显，有核分裂象
C. 通过血道转移
D. 组织来源
E. 肿瘤体积巨大

正确答案：D。组织来源

解析：癌是来源于上皮组织的恶性肿瘤，肉瘤是来源于间叶组织的恶性肿瘤，两者最主要的区别是组织来源不同（D对）。浸润性生长无包膜（A错）、异型性明显，有核分裂象（B错）、可通过血道转移（C错）以及晚期肿瘤体积巨大（E错）均为恶性肿瘤的特点，而癌与肉瘤都是恶性肿瘤，因此这些均不能作为两者之间的鉴别点。